既健脾消食，又止泻的中成药是
A. 小儿健胃糖浆
B. 婴儿健脾口服液
C. 龙牡壮骨颗粒
D. 小儿消食片
E. 小儿化滞散

正确答案：B。婴儿健脾口服液